直肠指检发现下列情况中，属于前列腺穿刺活检指征的是
A. 前列腺增大
B. 前列腺硬结
C. 前列腺触痛
D. 前列腺囊性变
E. 前列腺萎缩

正确答案：B。前列腺硬结

解析：前列腺硬结（B对）是前列腺癌可能性最大的查体特征。前列腺增大（A错）不具有特异性，且绝大多数的前列腺增大均为良性增生。前列腺触痛（C错）多为炎症反应的主要表现。前列腺囊性变（D错）多见于前列腺囊性增生的病理改变。前列腺萎缩（E错）多见于雌激素治疗后。